全口义齿修复后，由于垂直距离过低可能造成的影响
A. 咀嚼无力
B. 唇红部显窄
C. 面部下1/3的距离减小
D. 息止（牙合）间隙过大，面容苍老
E. 以上都是

正确答案：E。以上都是

解析：垂直距离恢复得过小表现为面部下1/3的距离减小，唇红部显窄，口角下垂，鼻唇沟变深，颏部前突。全口义齿戴入口中，看上去患者像没戴义齿似的，息止间隙偏大，咀嚼时用力较大，而咀嚼效能较低。掌握“全口义齿颌位关系及上（牙合）架”知识点。